一患者双侧上肢痛温觉消失，触压觉存在，其病变部位在
A. 后角
B. 白质前连合
C. 脊髓丘脑束
D. 丘脑腹后外侧核
E. 中央后回

正确答案：B。白质前连合

解析：患者双侧上肢痛温觉消失，触压觉存在，可见是躯干和四肢痛温觉、粗略触觉和压觉传导通路出现问题。该通路中，传导痛温觉的纤维（细纤维）在后根的外侧部入脊髓后角内，再终止于第2级神经元；传导粗略触觉和压觉的纤维（粗纤维）经后根内侧部进入脊髓后角内，再终止于第2级神经元。第二级神经元发出纤维上升 1-2 个节段经白质前连合交叉到对侧的外侧索和前索内上行，组成脊髓丘脑侧束和脊髓丘脑前束（侧束传导痛温觉，前束传导粗略触觉和压觉）。患者双侧上肢痛温觉消失，触压觉存在，可见是由于传导痛温觉和触觉的神经纤维在白质前连合（B对）交叉处存在病变，导致感觉分离。